健康调查量表（SF-36）适用于
A. 普通人群生命质量的测量
B. 临床试验及研究
C. 卫生政策评价
D. 以上都是
E. 以上都不是

正确答案：D。以上都是